急性炎症时组织变红的主要原因是
A. 组织间隙水肿
B. 炎症灶内炎细胞浸润
C. 炎症灶内血栓形成
D. 肉芽组织增生
E. 血管扩张，血流加快

正确答案：E。血管扩张，血流加快

解析：急性炎症时局部组织可见红、肿、热、痛和功能障碍，其中组织变红的主要原因是血管扩张和充血，血流加快等（E对），组织间隙水肿（A错）可导致组织肿胀。炎症灶内炎细胞浸润（B错）是炎症的一般表现。肉芽组织增生（D错）多见于组织损伤修复（P21）中。急性炎症过程中的血管反应可引起内皮细胞损伤、血流速度减慢，导致血栓形成（C错）。